治疗风寒痹痛、肠燥便秘的药物是
A. 白芍
B. 当归
C. 川芎
D. 何首乌
E. 熟地

正确答案：B。当归

解析：当归可补血活血，调经止痛，润肠通便。辛行温通，为活血行瘀之良药，用治风寒痹痛、肢体麻木，常与羌活、防风、秦艽等药同用；补血以润肠通便，用治血虚肠燥便秘（B对）。白芍苦、酸，微寒；入肝、脾经。可养血调经，敛阴止汗，柔肝止痛，平抑肝阳（A错）。川芎辛，温；入肝、胆、心包经。可活血行气，祛风止痛（C错）。何首乌苦、甘、涩，微温；入肝、心、肾经。制何首乌可补肝肾，益精血，乌须发，强筋骨，化浊降脂。生何首乌可解毒，消痈，截疟，润肠通便（D错）。熟地甘，微温；入肝、肾经。可补血滋阴，益精填髓（E错）。